"感时花溅泪，恨别鸟惊心"。这种情绪状态是
A. 心境
B. 激情
C. 应激
D. 美感
E. 悲哀

正确答案：A。心境

解析：心境：心境是指微弱、持久、带有渲染性的情绪状态。心境不同于其他情绪状态的显著特点是其不具有特定的对象性，即不针对任何特定事物，使人的一切体验和活动都染上这一色彩。“人逢喜事精神爽”、“感时花溅泪，恨别鸟惊心”即心境。心境持续的时间有很大差别，其长短依赖于引起心境的客观环境和主体的个性特点。心境产生看似没有明确的原因，但细究起来总是事出有因，有时是激烈情绪之后的余波，有时则是生活中大大小小的事件的积累，有些则是个人的气质、性格所致，甚至气候、环境、色彩等也能影响人的心境。掌握“情绪过程”知识点。